肝病患者使用的强心药
A. 地高辛
B. 乙胺丁醇
C. 洋地黄毒苷
D. 螺内酯
E. 利福平

正确答案：A。地高辛